患者，男，50岁。既往体健，查体时发现肝在右季肋下2cm，质硬、无压痛，脾可触及，其最可能的诊断为
A. 慢性活动性肝炎
B. 慢性持续性肝炎
C. 代偿期肝硬化
D. 肝淤血
E. 多囊肝

正确答案：C。代偿期肝硬化

解析：中年患者，既往体健，查体：肝在右季肋下2cm（肝大，正常肝脏肋下＜1cm），质硬、无压痛（肝硬化的触诊特点），脾可触及（门脉高压的表现），综合病史和查体，该患者最可能的诊断为代偿期肝硬化（C对）。慢性重度肝炎（P29）（A错）表现为乏力、食欲减退、腹胀、尿黄等，伴肝病面容、肝掌、蜘蛛痣、脾大等。慢性轻度肝炎（P29）（B错）病情较轻，可表现为轻度乏力、头晕、厌油、肝区不适、肝稍大有轻度触痛等。肝淤血（D错）可有多种原因引起，表现为呕吐、食欲减退、消瘦、肝大、腹水等。多囊肝（E错）临床上，囊肿小时无症状，囊肿较大时可压迫周围脏器，可有食后饱胀、恶心、呕吐、右上腹不适等症状，但脾不大。